伤寒的主要病变部位在
A. 十二指肠
B. 小肠上段
C. 小肠下段
D. 乙状结肠
E. 直肠

正确答案：C。小肠下段

解析：伤寒的病理变化主要表现为单核-巨噬细胞系统的增生性反应，回肠下段（C对）附近肠系膜淋巴结常出现明显肿大、充血。致病菌到达回肠下段，侵入回肠集合淋巴结的单核吞噬细胞内繁殖形成初发病灶，进一步侵入肠系膜淋巴结经胸导管进入血液循环，引起菌血症。